男性，重体力劳动工人，腰腿痛，并向左下肢放射，咳嗽喷嚏时加重。检查腰部活动明显受限，并向左倾斜，直腿抬高试验阳性。病程中无低热盗汗消瘦症状。为明确诊断，最有意义的检查是
A. X线检查
B. CT
C. 超声
D. 腰椎穿刺
E. 肌电图

正确答案：B。CT

解析：患者男性，重体力劳动工人，腰腿痛，向左下肢放射，咳嗽、喷嚏时加重（坐骨神经痛典型表现），腰部活动明显受限、向左倾斜、直腿抬高试验阳性（腰椎间盘突出症的典型体征），结合患者症状和体征，该患者最可能的诊断为腰椎间盘突出症，为明确诊断，最有意义的检查是MRI，其次为CT（B对）。CT能更好地显示脊柱骨性结构的细节，还能观察椎间小关节和黄韧带的情况。X线检查（P733）（A错）对腰椎间盘突出症病人的阳性发现较少，通常作为常规检查，不能确诊本病；B超（C错）对本病的诊断价值不大；腰椎穿刺（D错）多用于中枢神经系统感染、肿瘤等疾病的诊断；肌电图（P733）（E错）有助于腰椎间盘突出的诊断，并可以推断神经受损的节段，但其诊断价值不及MRI和CT。